患者，女，27岁，已婚。孕7个月，面目四肢浮肿，皮薄光亮，按之凹陷，气短懒言，纳少便溏，舌质胖嫩，边有齿痕，舌苔白腻，脉缓滑。治疗应首选
A. 真武汤
B. 苓桂术甘汤
C. 白术散(《全生指迷方》)
D. 天仙藤散
E. 四苓散

正确答案：C。白术散(《全生指迷方》)

解析：患者孕7个月，面目四肢浮肿，皮薄光亮，安之凹陷是因为脾阳不运，四肢凹陷；并伴有气短懒言，纳少便溏，舌质胖嫩等脾虚之象，是子肿之脾虚证，故用白术散以健脾利水（C对）。真武汤功效补肾温阳，化气行水。用于治疗子肿之肾虚证，以面目浮肿，下肢尤甚，按之如泥为鉴别要点(A错)。苓桂术甘汤功效温阳化饮，健脾利湿，用于治疗中阳不足之痰饮证（B错）。天仙藤散功效理气行滞，除湿消肿，用于子肿之气滞证，以肢体肿胀，始于两足，渐延于腿为鉴别要点（D错）。四苓散功效健脾渗湿，主治脾胃虚弱，水湿水停证。小便赤少，大便溏泄（E错）。